前腭杆形成前腭板与后腭杆连接，形成
A. 前腭板
B. “天窗”式腭板
C. 前腭杆
D. 后腭杆
E. 侧腭杆

正确答案：B。“天窗”式腭板

解析：腭板：前腭杆向前延伸至前牙舌隆突上而形成前腭板，再向左右两侧延伸形成马蹄状腭板（双侧游离缺失者）；如再与后腭杆连接，则成关闭型马蹄状腭板或“天窗”式腭板；如覆盖全腭区，则成全腭板。掌握“局部义齿连接体”知识点。